通过病员下颌的开闭颌运动、前伸运动和侧方运动，检查其关节功能是否正常，有无疼痛、弹响或杂音。属于以上哪项
A. 外形与关节动度检查
B. 咀嚼肌检查
C. 颈前三角检查
D. （牙合）关系检查
E. 下颌运动检查

正确答案：E。下颌运动检查

解析：下颌运动检查：通过病员下颌的开闭颌运动、前伸运动和侧方运动，检查其关节功能是否正常，有无疼痛、弹响或杂音；观察弹响发生的时间、性质、次数和响度；两侧关节动度是否一致，有无偏斜；开口度和开口型是否正常，以及在开闭口运动时是否出现关节绞锁等异常现象。掌握“口外一般检查及辅助检查”知识点。